具有氧化酶活性的是
A. 免疫球蛋白
B. 肌红蛋白
C. 脂蛋白
D. 铜蓝蛋白
E. 清（白）蛋白

正确答案：D。铜蓝蛋白

解析：铜蓝蛋白（D对）又称铜氧化酶，具有氧化酶活性，它可以催化Fe²⁺氧化为Fe³⁺。免疫球蛋白（A错）又称为抗体，在人体的体液免疫中起主要作用；肌红蛋白（B错）是一种氧结合血红素蛋白，主要分布于心肌和骨骼肌中；脂蛋白（C错）是血浆脂类物质与载脂蛋白结合后形成的，脂蛋白是脂类物质在血浆中的运输形式；清（白）蛋白（P155）（E错）最主要的功能是维持血浆胶体渗透压，还有运输作用，以上几种蛋白均不具有氧化酶活性。